上界为蝶骨大翼的颞下面和颞下嵴，下以翼外肌下缘平面为界，位于翼下颌间隙上方的是
A. 颞下间隙
B. 颊间隙
C. 翼颌间隙
D. 咬肌间隙
E. 眶下间隙

正确答案：A。颞下间隙

解析：颞下间隙位于翼下颌间隙上方。前界为上颌骨后面，后界为茎突及茎突诸肌，内界为蝶骨翼突外侧板，外界为下颌支上份及颧弓，上界为蝶骨大翼的颞下面和颞下嵴，下以翼外肌下缘平面为界。掌握“面侧深区及颌面部各间隙的境界”知识点。